劳动卫生学的基本任务主要是
A. 提高劳动卫生科学水平
B. 积极防治职业病
C. 识别、评价和控制不良劳动条件
D. 发展社会主义国民经济
E. 提高劳动生产率

正确答案：C。识别、评价和控制不良劳动条件

解析：本题考查劳动卫生学的基本任务。职业卫生学以前称劳动卫生学，是以职业人群为主要对象，主要研究劳动条件对职业人群健康的影响，主要任务是识别、评价、预测、控制和研究不良劳动条件（C对ABDE错），为保护职业从事者健康、提高作业能力、改善劳动条件所应采取的措施提供科学依据。